对2017年某地人口指标进行统计，发现与2016年相比，2017年少年儿童人口比例增加，则可能出现该地未来的
A. 死亡率增加
B. 死亡率下降
C. 出生率增加
D. 出生率下降
E. 人口自然增长率下降

正确答案：C。出生率增加